《中国药典》规定控释胶囊剂应检查
A. 溶出度
B. 脆碎度
C. 崩解时限
D. 释放度
E. 干燥失重

正确答案：D。释放度

解析：本题考查的是胶囊剂的质量要求。《中国药典》规定控释胶囊剂应检查释放度（D对）。释放度：缓释胶囊应符合缓释制剂的有关要求并应进行释放度检查；控释胶囊应符合控释制剂的有关要求并应进行释放度检查。肠溶胶囊应符合迟释制剂的有关要求，并进行释放度检查。根据原料药物和制剂的特性，除来源于动、植物多组分且难以建立测定方法的胶囊剂外，溶出度（B错）、释放度、含量均匀度等应符合要求。必要时，内容物包衣的胶囊剂应检查残留溶剂。崩解时限（A错）：凡规定检查溶出度或释放度的胶囊剂，一般不再进行崩解时限的检查。根据原料药物和制剂的特性，除来源于动、植物多组分且难以建立测定方法的胶囊剂外，溶出度、释放度、含量均匀度等应符合要求。胶囊剂无需检查脆碎度（C错）和干燥失重（E错）。复方中药胶囊剂无需检查溶出度或释放度，所以需要检查崩解时限。